氟康唑抗真菌的作用机制是
A. 阻止核酸合成
B. 抑制细胞膜麦角甾醇合成酶，使麦角甾醇合成受阻
C. 抑制二氢叶酸合成酶
D. 抑制二氢叶酸还原酶
E. 抑制蛋白质合成

正确答案：B。抑制细胞膜麦角甾醇合成酶，使麦角甾醇合成受阻

解析：麦角甾醇又称为麦角固醇，为真菌细胞膜中的一种重要成分，氟康唑属于三唑类抗真菌药，可抑制细胞膜麦角甾醇合成酶，干扰真菌细胞中麦角固醇的生物合成（B对），使真菌细胞膜缺损，增加膜通透性，进而抑制真菌生长或使真菌死亡。某些抗病毒药物可抑制病毒核酸复制，阻止核酸合成（A错），如碘苷抑制胸腺嘧啶核苷合成酶，影响DNA合成，吗啉双呱抑制病毒繁殖期各个阶段，阿昔洛韦、阿糖腺苷等抑制病毒DNA合成磺胺类为最早用于治疗全身性细菌感染的合成抗菌药，属于广谱抑菌药，抗菌机制主要为与PABA竞争二氢叶酸合成酶（C错），妨碍二氢叶酸的合成，进而影响核酸的合成，从而抑制细菌的生长繁殖。甲氧苄啶属于二氢叶酸还原酶抑制剂（D错），可抑制二氢叶酸还原成为四氢叶酸，阻碍四氢叶酸合成，也磺胺类合用使细菌叶酸代谢收到双重阻断，抗菌作用增强。氨基糖苷类、大环内脂类、林可霉素、克林霉素、氯霉素等抗生素主要抑制细菌蛋白质的合成（E错）。